恶性淋巴瘤可发生在
A. 口咽
B. 牙龈
C. 腭
D. 颊
E. 以上都可

正确答案：E。以上都可

解析：口腔颌面部恶性淋巴瘤可发生于牙龈、腭、颊、口咽以及颌骨等部位。掌握“恶性淋巴瘤”知识点。